贯穿结扎法最适用的是
A. 内痔嵌顿
B. 静脉曲张性外痔
C. 血栓性外痔
D. 赘皮外痔
E. Ⅱ、Ⅲ期内痔

正确答案：E。Ⅱ、Ⅲ期内痔

解析：内痔嵌顿是内痔在某些因素的作用下脱出肛外，是吻合器痔固定术的适应证（A错）。静脉曲张性外痔是静脉丛剥离术的适应证（B错）。血栓性外痔较大，血块5~7天不能吸收，炎症水肿局限者，或疼痛难忍者适用血栓外痔剥离术（C错）。赘皮外痔即结缔组织外痔，一般不需要治疗，若反复发炎或赘皮较大、影响清洁卫生者，可考虑在无炎症的情况下手术切除（D错）。贯穿结扎法的适应证为II~IV期内痔，对纤维型内痔更为适宜（E对）。